下列除哪项外，均是气血不足证的常见脉象
A. 虚
B. 细
C. 弱
D. 微
E. 结

正确答案：E。结

解析：虚脉多见于虚证，多为气血两虚（A错）。细脉多见于气血两虚，湿邪为病（B错）。弱脉多见于阳气虚衰、气血俱虚（C错）。微脉多见于气血大虚，阳气衰微（D错）。结脉多见于阴盛气结，寒痰血瘀，但亦可见于气血虚衰，若久病气血虚衰，尤其是心气、心阳虚衰，脉气不续，致脉来缓慢而时有一止，且为结而无力，但不属于气血不足证的常见脉象（E对）。